肉桂的性能特点有
A. 辛甘而热
B. 苦降而燥
C. 有毒力猛
D. 温补行散
E. 气厚纯阳

正确答案：A、D、E。辛甘而热；温补行散；气厚纯阳

解析：本题考查肉桂的性能特点。肉桂的性能特点有辛甘而热（A对）、温补行散（D对）、气厚纯阳（E对）。肉桂【性能特点】本品辛甘而热，温补行散，气厚纯阳。入肾经，缓补肾阳而补火助阳或引火归元。入肝、心、脾经，消沉寒痼冷而散寒止痛，温通经脉而活血散瘀。助阳不及附子，回阳救逆一般不用。既长于益阳消阴、缓补肾阳与引火归元，为补火助阳之要药；又入血分，善温通经脉，改善微循环，血瘀有寒者宜用。吴茱萸【性能特点】本品辛热香散，苦降而燥（B错），有小毒，力较强。主入肝经，兼入脾、胃、肾经。善疏肝降厥阴上逆之寒气、暖肝散寒、温阳燥湿、和肝胃而制酸、止痛、止呃，并兼杀虫。外用既燥湿杀虫而止痒，又引火、引血下行而降血压。善治肝寒气逆（滞）夹湿兼阳虚诸证。药力强，内服、外用皆宜。附子【性能特点】本品辛热纯阳，有毒力猛（C错），入心、肾、脾经。上助心阳、中温脾阳、下壮肾阳，为补火助阳、回阳救逆之要药，治亡阳及阳虚诸证每用。辛热走散，为散阴寒、除风湿、止疼痛之猛药，治寒湿诸痛常投。